患者，男，28岁。3天来尿道口红肿，尿急、尿频、尿痛，淋沥不止，尿液混浊如脂，尿道口溢脓，舌红苔黄腻，脉滑数，西医诊断为急性淋病。治疗应首选
A. 知柏地黄丸
B. 龙胆泻肝汤
C. 清营汤
D. 萆蘚渗湿汤
E. 四妙勇安汤

正确答案：B。龙胆泻肝汤

解析：淋病，是由淋病双球菌所引起的泌尿生殖系感染的性传播疾病，中医称之为‘花柳毒淋’，其特点是：以尿道刺激、尿道口排出脓性分泌物为主症，临床辨证分型分为湿热毒蕴证（急性淋病）和阴虚毒恋证（慢性淋病），本病诊断急性淋病明确，属湿热毒蕴证，湿热秽浊之邪由下焦前阴窍口侵入，出现尿道口红肿；阻滞于膀胱及肝经，气化失司，出现尿急、尿频、尿痛，淋沥不止；局部气血运行不畅，湿热熏蒸，精败肉腐，出现尿液混浊如脂，尿道口溢脓；舌红苔黄腻，脉滑数，为湿热内蕴之象，其治法为清热利湿，解毒化浊，方药为龙胆泻肝汤酌加土茯苓、红藤、萆薢等（B对）。知柏地黄丸，具有滋阴降火的作用，用于复发性口疮、红斑狼疮阴虚内热证（A错）。清营汤，用于湿热毒蕴证，热毒入络者，不符合题干首选要求（C错）。萆蘚渗湿汤，具有清利湿热的作用，用于脚湿气、下肢丹毒及湿疮等（D错）。四妙勇安汤，具有清热解毒、活血滋阴的作用，用于脱疽溃烂，局部红肿热痛（E错）。